关于流感病毒的特点，哪一项是错误的
A. 是有包膜病毒
B. 具有神经氨酸酶(NA)刺突
C. 不易发生抗原性变异
D. 具有分节段的RNA和核蛋白(NP)
E. 具有血凝素HA刺突

正确答案：C。不易发生抗原性变异

解析：正粘病毒只有流行性感冒病毒（流感病毒）。病毒体结构主要包括分节段的单负链RNA病毒核酸与蛋白组成的核衣壳和包膜。在包膜上镶嵌哟血凝素HA和神经氨酸酶NA两种刺突，这两种刺突的抗原结构易发生变异。掌握“正、副黏病毒”知识点。